经行发热之瘀热壅阻证的治法为
A. 活血祛瘀
B. 化瘀清热
C. 凉血养血
D. 疏风活血
E. 养血活血

正确答案：B。化瘀清热

解析：瘀热交结阻碍血行，经行瘀阻不通，营卫失和，则经前、经期发热，治宜化瘀清热（B对），方药选用血府逐瘀汤加丹皮。